用微量凯氏定氮法测出某肉类制品含氮量为4％，其蛋白质含量为
A. 20%
B. 25%
C. 30%
D. 35%
E. 40%

正确答案：B。25%